强心甾苷元与（6-去氧糖）ₓ-（D-葡萄糖）y结合后生成的是
A. Ⅰ型强心苷
B. Ⅱ型强心苷
C. Ⅲ型强心苷
D. A型人参皂苷
E. B型人参皂苷

正确答案：B。Ⅱ型强心苷

解析：本题考查的是强心苷的糖与苷元的连接方式。强心甾苷元与（6-去氧糖）ₓ-（D-葡萄糖）y结合后生成的是Ⅱ型强心苷（B对）。强心苷由强心甾苷元与不同的糖连接而成，按糖的种类及其与苷元的连接方式，将强心苷分为以下三种类型。Ⅰ型（A错）：苷元-（2，6-去氧糖）ₓ-（D-葡萄糖）y，如紫花洋地黄苷A；Ⅱ型：苷元-（6-去氧糖）ₓ-（D-葡萄糖）y，如黄夹苷甲；Ⅲ型（C错）：苷元-（D-葡萄糖）y，如绿海葱苷。A型人参皂苷（D错）为指人参皂苷分类中的人参皂苷二醇型，母核是四环三萜中的达玛烷型。B型人参皂苷（E错）为指人参皂苷分类中的人参皂苷三醇型，母核也是四环三萜中的达玛烷型。